下列各项，除哪项外，均是虚喘的特有症状
A. 呼吸浅短难续
B. 呼出为快
C. 气怯声低
D. 深吸为快
E. 遇劳加重

正确答案：B。呼出为快

解析：虚喘，呼吸短促难续（A对）,深吸为快（D对）；声音气怯声低（C对）；兼证少有痰；脉象微弱或浮大中空；病势徐缓,时轻时重,遇劳即甚（E对）。实喘，呼吸深长有余,呼出为快（B错，为本题正确答案）；声音气粗声高；兼证痰鸣咳嗽；脉象数而有力；病势急骤。